目前我国疾病监测的种类有
A. 甲、乙、丙3类传染病监测
B. 传染病监测、非传染病监测和其他卫生问题监测
C. 呼吸道传染病监测、肠道传染病监测
D. 恶性肿瘤、心血管病、脑血管病监测
E. 发病学监测、血清学监测、病原学监测、干预措施的监测

正确答案：B。传染病监测、非传染病监测和其他卫生问题监测